上述哪项指标反映左心室的后负荷
A. 左心收缩期室壁张力
B. 中心静脉压
C. 肺动脉压
D. 右心室舒张末期压力
E. 左心室舒张末期压力

正确答案：A。左心收缩期室壁张力

解析：左心室的后负荷是指左心室射血时所要克服的阻力，相当于左心室收缩期室壁张力（A对）。